某村发生一起民居垮塌事故，重伤者9人，急送乡卫生院抢救。市中心血站根据该院用血要求，急送一批无偿献血的血液到该院。抢救结束后，尚余900ml血液，该院却将它出售给另一医疗机构。《献血法》规定，对于乡卫生院的这一违法行为，县卫生局除了应当没收其违法所得外，还可以对其处以罚款
A. 10万元以下
B. 5万元以下
C. 3万元以下
D. 1万元以下
E. 5千元以下

正确答案：A。10万元以下

解析：《献血法》规定，有下列行为之一的，由县级以上地方人民政府予以取缔，没收违法所得，可以并处10万元以下的罚款；构成犯罪的，依法追究刑事责任：①非法采集血液的；②血站、医疗机构出售无偿献血的血液的；③非法组织他人出卖血液的。该乡卫生院在抢救重伤者后，将剩余的900ml无偿献血的血液出售给另一医疗机构据，违反了《献血法》规定，县卫生局除了应当没收其违法所得外，还可以对其处以10万元以下（A对）的罚款。